关于肝尾叶的说法，何者不对
A. 位于肝门的后方
B. 其右界是腔静脉沟
C. 其左侧的纵沟内含肝圆韧带
D. 尾叶连同方叶和肝脏面的右叶相当膈面的右叶
E. 形成网膜囊上界的一部分

正确答案：C。其左侧的纵沟内含肝圆韧带

解析：肝尾叶位于肝门后方(A对)，右侧是腔静脉沟(B对)，左侧为静脉韧带裂，内含静脉韧带(C错，为本题正确答案)，脏面的尾叶连同方叶及右叶相当于膈面的右叶(D对)，肝尾叶与膈下方腹膜共同形成网膜囊上界(E对)。